女性，52岁。有胆管结石病史，近2天来右上腹疼痛，体温37.8度，2小时前突然畏寒、寒战，体温达40℃，精神紧张兴奋，口渴，面色苍白，脉搏98次/分，有力，血压110/96mmHg，尿量26ml。下列哪一项不是其微循环变化的特征
A. 微动脉，微静脉收缩
B. 动静脉短路开放
C. 直捷通道开放
D. 组织灌流减少
E. 静脉回心血量减少

正确答案：E。静脉回心血量减少

解析：患者精神紧张兴奋、口渴、面色苍白提示出现休克。根据休克的分级标准（P30），患者脉搏98次/分、有力，血压110/96mmHg（收缩压正常，舒张压升高），尿量26ml（正常，尿量低于17ml/h称为少尿），提示病人处于休克代偿期，即休克早期。休克早期，交感神经兴奋，组织微动脉、微静脉收缩（A对），动静脉短路（B对）、直捷通路大量开放（C对），使外周血管阻力和回心血量增加（E错，为本题正确答案）。但由于毛细血管前括约肌收缩导致“只出不进”，组织灌注减少（D对）。